某医院定期对所属45岁以上的干部做体检，包括超声波检查肝、脾、胃，胸透、心电图，并查血、尿、粪，以发现可疑结核、心血管病、糖尿病、直肠癌和肝癌等。这是
A. 单项筛检
B. 多项筛检
C. 整群筛检
D. 选择性筛检
E. 多病种筛检

正确答案：E。多病种筛检

解析：本题考查多病种筛检的定义。多病种筛检（E对ABCD错）是同时在一个人群中开展多种疾病筛查。题中对45岁以上人群开展多种疾病的筛查满足多病种筛检的定义。